慢性肺源性心脏病血液检查描述正确的是
A. 中性粒细胞降低
B. 白细胞粒数可增高
C. 红细胞降低
D. 血红蛋白降低
E. 血小板增高

正确答案：B。白细胞粒数可增高

解析：血液检查：红细胞及血红蛋白可升高，全血黏度及血浆黏度可增加；合并感染时白细胞粒数增高，中性粒细胞增加。掌握“慢性肺源性心脏病”知识点。